薯类中含量最多的是
A. 蛋白质
B. 维生素
C. 矿物质
D. 淀粉
E. 脂肪

正确答案：D。淀粉